对于血小板的聚集起重要作用的物质是
A. 纤维蛋白质
B. 凝血酶
C. Ca²⁺
D. ADP与血栓素A₂
E. 花生四烯酸

正确答案：D。ADP与血栓素A₂